取药材数粒，加水共研，发生苯甲醛特殊香气的药材是
A. 苦杏仁
B. 五味子
C. 马钱子
D. 砂仁
E. 决明子

正确答案：A。苦杏仁

解析：本题考查的是苦杏仁的成分。取药材数粒，加水共研，发生苯甲醛特殊香气的药材是苦杏仁（A对）。苦杏仁苷是一种氰苷，易被酸和酶所催化水解。水解所得到的苷元α-羟基苯乙腈很不稳定，易分解生成苯甲醛和氢氰酸。其中苯甲醛具有特殊的香味。通常将此作为鉴别苦杏仁苷的方法。五味子（B错）【成分】果实含挥发油0.89%。油中含古巴烯、麝子油烯、倍半蒈烯等。含木脂素约5%，为本品的有效成分。马钱子（C错）【成分】马钱种子含总生物碱2%～5%，主要为番木鳖碱（士的宁），异番木鳖碱，马钱子碱，另含微量的番木鳖次碱、伪番木鳖碱、伪马钱子碱、异马钱子碱等。砂仁（D错）【成分】阳春砂种子含挥发油3%以上，油中主成分为乙酸龙脑酯、芳樟醇、橙花叔醇、龙脑、樟脑、柠檬烯等；又含皂苷（约0.69%）及锌、铁、锰、铜等。决明子（E错）【成分】决明种子含游离羟基蒽醌衍生物，为大黄酚、大黄素、大黄素甲醚、决明素、橙黄决明素、钝叶素、决明苷等。